在苯二氮䓬结构中1，2位并合甲基三氮唑环，并含有氟苯基团，临床常用于手术前或术中镇静的药物是
A. 咪达唑仑
B. 奥沙西泮
C. 依替唑仑
D. 奥沙唑仑
E. 艾司唑仑

正确答案：A。咪达唑仑

解析：本题考查镇静催眠药的结构改造。咪达唑仑（A对）是将三唑仑分子中的三氮唑用咪唑替代得到的，用于治疗失眠症，亦可用于外科手术或诊断检查时作诱导睡眠用。